健康相关生命质量评价在临床医学的应用主要集中在
A. 肿瘤和慢性非传染性疾病
B. 传染病和寄生虫病
C. 呼吸系统疾病
D. 结核
E. 艾滋病

正确答案：A。肿瘤和慢性非传染性疾病